胫骨上端的骨性标志是
A. 内踝
B. 外踝
C. 胫骨粗隆
D. 腓关节面
E. 比目鱼肌线

正确答案：C。胫骨粗隆

解析：胫骨上端前面的隆起称胫骨粗隆，于体表可扪到（C对）。内踝属于胫骨下端的结构（A错）。外踝属于腓骨的结构（B错）。腓关节面、比目鱼肌线均不可在体表扪及（DE错）。